下列属于疾病三间分布的是
A. 时间、地区、人群
B. 散发、流行、大流行
C. 散发、流行、暴发
D. 周期性、季节性、长期性
E. 以上都不是

正确答案：A。时间、地区、人群

解析：疾病的三间分布是指地区分布、时间分布、人群分布（A对）。